B细胞表面最重要的标志为
A. SmIg
B. FcγR
C. CD40
D. CD5
E. CD80

正确答案：A。SmIg

解析：SmIg（B细胞膜表面免疫球蛋白）（A对）是B细胞的特征性表面标志，能结合特异性抗原。Fcγ受体（FcγR）（B错）是IgG Fc段受体，主要表达于免疫细胞膜上，在特异性抗体和效应细胞功能间象桥梁一样使体液免疫和细胞免疫紧密关联。CD40（C错）组成性的表达于成熟B细胞，CD40的配体（CD40L即CD154）表达于活化T细胞。CD5（D错）是T细胞的表面标志。CD80（E错）和CD86在静息B细胞不表达或低表达，在活化B细胞表达增强，它与T细胞表面的CD28和CTLA-4相互作用，CD28提供T细胞活化的第二信号，CTLA-4抑制T细胞活化信号。